精神分裂症的遗传方式，目前认为可能性最大的是
A. 单基因遗传
B. 常染色体数目异常
C. 性染色体数目异常
D. 多基因遗传
E. 染色体缺失

正确答案：D。多基因遗传

解析：遗传因素子在精神分裂症发生中具有重要作用。目前认为多基因遗传（D对）可能性最大。也有人认为常染色体单基因遗传或多缘性遗传。